属于电解质补充药，可用于低钾血症和洋地黄中毒引起的心律失常的药物是
A. 异甘草酸镁
B. 多烯磷脂酰胆碱
C. 双环醇
D. 门冬氨酸钾镁
E. 腺苷蛋氨酸

正确答案：D。门冬氨酸钾镁

解析：本题考查药物的适应证。门冬氨酸钾镁（D对）属于电解质补充药，用于低钾血症、低钾及洋地黄中毒引起的心律失常，心肌代谢障碍所致的心绞痛、心肌梗死、心肌炎后遗症，慢性心功能不全，急性黄疸性肝炎、肝细胞功能不全和急、慢性肝炎的辅助治疗。异甘草酸镁（A错）通过各种机制发挥抗炎作用。多烯磷脂酰胆碱（B错）为必需磷酯类肝胆疾病辅助用药。双环醇（C错）用于治疗慢性肝炎所致的氨基转移酶升高。腺苷蛋氨酸（E错）为利胆药。